椎动脉到达脑的行程中穿过
A. 圆孔
B. 卵圆孔
C. 棘孔
D. 枕骨大孔
E. 椎间孔

正确答案：D。枕骨大孔

解析：椎动脉起于前斜角肌的内侧，经枕骨大孔（D对）入颅腔，分支布于脑与脊髓。